按十二经脉分布规律，太阳经行于
A. 面额
B. 头部
C. 头侧
D. 前额
E. 面部

正确答案：B。头部

解析：本题考查十二经脉分布规律，属理解记忆内容。手太阳经主要行于面颊部，足太阳经行于头顶和头后部，从此可得出太阳经行于头部（B对）。